以下关于唇的解剖的描述中，不正确的是
A. 上界为鼻底，下界为颏唇沟
B. 红唇即口裂的两端
C. 上唇的红唇缘整体呈M形为唇弓
D. 口裂将唇分为上唇和下唇
E. 两侧以唇面沟为界

正确答案：B。红唇即口裂的两端

解析：唇的境界：唇的上界为鼻底，下界为颏唇沟，两侧以唇面沟为界，其中部有口裂将唇分为上唇和下唇。口角即口裂的两端，红唇为上下唇的游离缘，是皮肤和黏膜的移行区。掌握“口腔境界及唇、颊的局部解剖”知识点。